黄嘌呤酶类存在于
A. 肝细胞内
B. 血管内皮细胞内
C. 巨噬细胞内
D. 肌细胞内
E. 中性粒细胞内

正确答案：B。血管内皮细胞内

解析：黄嘌呤氧化酶(XO)的前身是黄漂呤脱氢酶(XD), 这两种酶主要存在于毛细血管内皮细胞内（B对）。